属于顺式作用元件的是
A. 转录抑制因子
B. 转录激活因子
C. σ因子
D. ρ因子
E. 增强子

正确答案：E。增强子

解析：调节序列与被调控的编码序列位于同一条DNA链上的调节序列，被称为顺式作用元件。顺式作用元件包括启动子、增强子（E对）和沉默子等。另外一些调节序列远离被调控的编码序列，实际上是其他分子的编码基因，只能通过其表达产物来发挥作用。这样的调节基因产物不仅能对处于同一条DNA链上的结构基因的表达进行调控，而且还能对不在一条DNA链上的结构基因的表达起到同样的作用，这些蛋白被称为反式作用因子。转录抑制因子（A错）和转录激活因子（B错）均属于反式作用因子。σ因子（C错）在原核生物RNA聚合酶中可以辨认转录起始区和转录起点，ρ因子（D错）是部分原核生物中能控制转录终止的蛋白质。